尿蛋白主要为白蛋白的为
A. 肾小管性蛋白尿
B. 溢出性蛋白尿
C. 肾小球性蛋白尿
D. 分泌性蛋白尿
E. 组织性蛋白尿

正确答案：C。肾小球性蛋白尿

解析：尿蛋白主要为白蛋白的为肾小球性蛋白尿（C对）。肾小球滤过膜有分子屏障和电荷屏障，分子屏障保证只有分子量较小的蛋白质可以通过；电荷屏障是由于滤过膜带负电荷，通过同性相斥的原理来阻止带负电荷的血浆蛋白（如白蛋白）滤过。因此，肾小球滤过的原尿中主要为小分子蛋白质（如溶菌酶、β₂微球蛋白、轻链蛋白等），白蛋白（分子量6.9万）及分子量更大的免疫球蛋白含量很少。当肾小球的屏障功能受损时，血浆蛋白大量滤出，因血浆蛋白以白蛋白为主，因此肾小球性蛋白尿主要为白蛋白。肾小管性蛋白尿（P461）（A错）是以溶菌酶、β₂微球蛋白为主。溢出性蛋白尿（八版内科学P461）（B错）主要以多发性骨髓瘤轻链蛋白、血红蛋白、肌红蛋白等小分子蛋白为主。分泌性蛋白尿（D错）即组织性蛋白尿（九版诊断学P305）（E错）是由于肾小管分泌蛋白增多或肾组织被破坏所致的蛋白尿，多为低相对分子质量蛋白尿，以T-H糖蛋白为主要成分。